由病人的家长、家属或他人作出求医决定的求医类型是
A. 主动求医型
B. 被动求医型
C. 强制求医型
D. 顾虑求医型
E. 合作求医型

正确答案：B。被动求医型

解析：自我意识尚未发育成熟的未成年人、意识丧失或缺乏自制能力以及体质虚弱的老人等患者，需由患者家长、家属或者他人作出求医决定而产生求医行为，都属于被动求医型。掌握“医患沟通的理论、技术与其应用以及医患关系模式”知识点。